食物的氧热价是指
A. 1g食物氧化时所释放的能量
B. 1g食物燃烧时所释放的能量
C. 食物氧化消耗1升氧时所释放的能量
D. 氧化1g食物，消耗1升氧时所释放的能量
E. 1g食物所含的能量

正确答案：C。食物氧化消耗1升氧时所释放的能量

解析：食物的氧热价是食物氧化时消耗1L氧气所产生的热量（C对），食物的热价是1g某种食物氧化时所释放的能量（A错）。食物的物理热价是1g食物燃烧时所释放的能量（B错）。